右侧视束损伤可造成
A. 左眼全盲
B. 右眼全盲
C. 双眼颞侧半视野偏盲
D. 左眼鼻侧及右眼颞侧视野偏盲
E. 右眼鼻侧及左眼颞侧视野偏盲

正确答案：E。右眼鼻侧及左眼颞侧视野偏盲

解析：一侧视束及以后的视觉传导路（视辐射、视区皮质）受损，可致双眼病灶对侧半视野同向性偏盲，如右侧受损则右眼鼻侧及左眼颞侧视野偏盲（E对）；视交叉中央部损伤，双眼鼻侧神经受损导致双眼颞侧半视野偏盲；一侧视神经损伤可致该侧眼视野全盲；一侧视交叉外侧部的不交叉纤维损伤，则患侧眼视野的鼻侧半偏盲。